男，31岁。5天前因十二指肠球部溃疡行毕Ⅱ式胃大部切除术，今晨出现腹痛、腹胀、恶心，呕吐少量血性液体，查体：腹肌紧张，伴压痛、反跳痛，右侧显著。血常规：Hb120g/L，WBC11.2×10⁹/L，N0.85，Plt112×10⁹/L，最可能的诊断是
A. 十二指肠残端破溃
B. 胃肠吻合口漏
C. 急性胰腺炎
D. 胆囊穿孔
E. 应激性溃疡穿孔

正确答案：B。胃肠吻合口漏

解析：中年男性患者，十二指肠球部溃疡行毕Ⅱ式胃大部切除术5天，突然右上腹部剧痛、腹胀、恶心，呕吐少量血性液体，查体：腹肌紧张，伴压痛、反跳痛（是腹膜炎的典型体征），右侧显著。血常规：Hb120g/L（男性Hb正常值为120～160g/L），WBC11.2×10⁹/L（男性WBC正常值（4～10）×10⁹/L，提示感染），N0.85（正常值0.50～0.75），Plt112×10⁹/L（Plt正常值为100～300×10⁹/L），提示存在感染，结合患者症状、体征和影像学检查，该患者最可能的诊断是胃肠吻合口漏（B对）引起的继发性腹膜炎。十二指肠残端破溃（A错）多发生在术后24~48小时，见于十二指肠残端处理不当或毕Ⅱ式输入袢梗阻。腹部检查虽然也有腹膜刺激体征，但腹腔穿刺可得腹腔液含胆汁。急性胰腺炎（C错）腹痛多位于左上腹，向左肩及左腰背部放射。胆囊穿孔（D错）多有胆囊炎病史，与该患者病史不符。应激性溃疡穿孔（E错）腹式呼吸减弱或消失，全腹压痛，但以穿孔处最重，立位X线检查膈下可见新月状游离气体影。